下列除哪项外，均可出现周围性呕吐
A. 洋地黄中毒
B. 急性胃炎
C. 胃穿孔
D. 胆囊炎
E. 咽部受激惹

正确答案：A。洋地黄中毒

解析：呕吐可分为反射性呕吐、中枢性呕吐和前庭障碍性呕吐。反射性呕吐，即周围性呕吐，包括①咽部受到刺激（E对）；②胃、十二指肠疾病：如急性胃炎（B对）、消化性溃疡及穿孔（C对）等；③肠道疾病；④肝胆胰疾病：如急性肝炎、急慢性胆囊炎（D对）等；⑤腹膜及肠系膜疾病等。洋地黄中毒引起的呕吐（A错，为本题正确答案）为中枢性呕吐。